卵子受精一般在输卵管的哪部分
A. 漏斗部
B. 壶腹部
C. 峡部
D. 子宫部
E. 输卵管腹腔口

正确答案：B。壶腹部

解析：壶腹部（B对）是卵子在输卵管受精的部位。